开展药学信息服务最终受益的是
A. 医师
B. 护士
C. 药师
D. 病人
E. 国家

正确答案：D。病人

解析：本题考查药物信息服务。药物信息服务的主要目的是解决患者用药问题，使患者用药更安全、有效、合理，最终的受益者是患者（D对）。